直接注入心腔内的是
A. 左冠状动脉
B. 右冠状动脉
C. 心大静脉
D. 心小静脉
E. 心最小静脉

正确答案：E。心最小静脉

解析：心最小静脉（E对）是位于心壁内的小静脉，直接注入心房或心室腔内。